既攻毒杀虫，又利水通便的药是
A. 轻粉
B. 硫黄
C. 雄黄
D. 鸦胆子
E. 土荆皮

正确答案：A。轻粉

解析：本题考查的是轻粉的功效。既攻毒杀虫，又利水通便的药是轻粉（A对）。轻粉：【功效】外用杀虫、攻毒、敛疮；内服祛痰消积，逐水通便。硫黄（B错）：【功效】外用解毒杀虫止痒，内服补火助阳通便。雄黄（C错）：【功效】解毒，杀虫，燥湿祛痰，截疟定惊。鸦胆子（D错）：【功效】清热解毒，燥湿杀虫，止痢截疟，腐蚀赘疣。土荆皮（E错）：【功效】杀虫，疗癣，止痒。